参苏丸既能疏风散寒、祛痰止咳，又能
A. 疏风解表
B. 解表清热
C. 宣肺止咳
D. 益气解表
E. 解肌清热

正确答案：D。益气解表

解析：本题考查的是参苏丸的功能。参苏丸既能疏风散寒、祛痰止咳，又能益气解表（D对）。参苏丸：【功能】益气解表，疏风散寒，祛痰止咳。感冒清热颗粒：【功能】疏风散寒（A错），解表清热（B错）。桑菊感冒片：【功能】疏风清热，宣肺止咳（C错）。葛根芩连丸：【功能】解肌透表，清热（E错）解毒，利湿止泻。